肺段支气管是支气管树的
A. 第1-4级
B. 第2-4级
C. 第3-4级
D. 第3级
E. 第2级

正确答案：D。第3级

解析：肺段支气管是支气管树的第3级（D对）。